属于留钾利尿药，可作为原发性醛固酮多症诊断和治疗的药物是
A. 吲达帕胺
B. 螺内酯
C. 呋塞米
D. 托拉塞米
E. 氢氯噻嗪

正确答案：B。螺内酯

解析：本题考查留钾利尿药。螺内酯（B对）可用于原发性醛固酮增多症的诊断和治疗。